女，74岁。行胃癌根治术后7天，咳嗽后腹正中伤口内有多量淡红色液体流出。最可能出现的情况是
A. 切口下异物
B. 切口皮下积液
C. 切口裂开
D. 切口感染
E. 切口内血肿

正确答案：C。切口裂开

解析：患者为老年女性，胃癌根治术后7天，咳嗽后伤口有多量淡红色液体流出，最可能出现的情况是切口裂开（C对）。切口裂开常发生于术后1周之内，往往在病人一次腹部突然用力时（如咳嗽），自觉切口疼痛和突然松开，有淡红色液体自切口溢出。切口下异物（A错）可见异物反应，伤口充血红肿。切口皮下积液（B错）主要表现为切口局部水肿。切口感染（D错）常表现为切口炎症反应，局部红、肿、热、痛，有分泌物。切口内血肿（E错）也可在咳嗽后出现，常表现为为切口部位不适感，肿胀及边缘隆起、变色，有时出现血液外渗（流出的是血液，而非淡红色液体）。